称
A. 颈动脉壁
B. 盖壁
C. 颈静脉壁
D. 鼓膜壁
E. 迷路壁

正确答案：B。盖壁

解析：颈动脉壁（A错）为鼓室前壁。盖壁（B对）为鼓室上壁。颈静脉壁（C错）为鼓室下壁。鼓膜壁（D错）为鼓室外侧壁。迷路壁（E错）为鼓室内侧壁。